关于滴丸的叙述，正确的有
A. 用滴制法制成的球状固体制剂称为滴丸
B. 药物在水溶性滴丸基质中分散度大，溶出速度快，故其生物利用度高
C. 聚乙二醇6000或聚乙醇4000为滴丸常用的水溶性基质
D. 水溶性基质的滴丸制备时，常选用甲基硅油、液体石蜡等作为冷却剂
E. 液滴与冷却剂的密度差是影响滴丸圆整度的因素之一

正确答案：A、C、D、E。用滴制法制成的球状固体制剂称为滴丸；聚乙二醇6000或聚乙醇4000为滴丸常用的水溶性基质；水溶性基质的滴丸制备时，常选用甲基硅油、液体石蜡等作为冷却剂；液滴与冷却剂的密度差是影响滴丸圆整度的因素之一